男性，40岁。近5个月来上腹胀痛，反酸，近3个月来反复呕吐，呕吐物为酸性宿食，按幽门梗阻内科治疗5天后缓解。如内科治疗1周不见好转，应如何处理
A. 继续胃肠减压、补液
B. 手术治疗
C. 抗酸治疗
D. 抗生素治疗
E. 口服胃黏膜保护剂

正确答案：B。手术治疗

解析：青年男性患者，上腹胀痛、反酸、呕吐，呕吐物为酸性宿食，如果按幽门梗阻内科治疗1周不见好转，应考虑为消化性溃疡所致的瘢痕性幽门梗阻。溃疡引起的幽门梗阻有水肿性、痉挛性和瘢痕性三种。瘢痕性幽门梗阻经1周胃肠减压、补液、抗酸及给予抗生素等内科治疗后不能缓解，需手术治疗（B对）。胃肠减压、补液（A错）、抗酸治疗（C错）、抗生素治疗（D错）为非手术治疗方法，适用于炎症水肿性幽门梗阻。口服胃粘膜保护剂（E错）可用于胃溃疡的治疗，对胃溃疡引起的幽门梗阻的治疗意义不大。